溶血性黄痘时，下列哪项不存在
A. 血中游离胆红素增加
B. 粪胆素原增加
C. 尿胆素原增加
D. 尿中出现胆红素
E. 粪便颜色加深

正确答案：D。尿中出现胆红素